女性，26岁，10天来全身皮肤出血点伴牙龈出血来诊。实验室检查：PLT35×109/L，临床诊断为慢性特发性血小板减少性紫癜（ITP）该患者的首选治疗是
A. 糖皮质激素
B. 脾切除
C. 血小板输注
D. 长春新碱
E. 达那唑

正确答案：A。糖皮质激素

解析：ITP的治疗首选糖皮质激素，因为血小板在10×109/L以上，出血不严重，所以不宜进行血小板输注。其他均不作为首选治疗，仅用于糖皮质激素治疗效果不佳或无效时。掌握“特发性血小板减少性紫癜（ITP）”知识点。